心室内肉柱位于
A. 与腿索相连处
B. 左、右心室流出道
C. 房间隔和室间隔两侧
D. 左、右心室流入道
E. 均不是

正确答案：D。左、右心室流入道

解析：心室内肉柱位于左、右心室流入道（D对），为纵横交错的肌性隆起，故腔面凹凸不平。